尿毒症性脑病的发病原因是
A. 血中尿毒症毒素蓄积
B. 能量代谢障碍
C. 水、电解质代谢紊乱
D. 代谢性酸中毒
E. 以上多种因素共同作用

正确答案：E。以上多种因素共同作用

解析：尿毒症性脑病发生机制尚不清楚，可能是血中尿毒症毒素的蓄积（A对），脑循环与脑代谢障碍，水、电解质平衡失调（C对）和代谢性酸中毒（D对）等因素共同作用的结果（E对）。